哮喘未发之时，常怯寒自汗，容易感冒，发作前每有鼻塞流涕其治法是
A. 补肾纳气
B. 补肺固卫
C. 健脾化痰
D. 温肺化痰，止咳平喘
E. 回阳固脱，温肺平喘

正确答案：B。补肺固卫

解析：根据本病例患者“哮喘未发之时”，当处于支气管哮喘缓解期。根据其“怯寒自汗，容易感冒，发作前每有鼻塞流涕”可诊断为支气管哮喘缓解期之肺气虚弱证，治以补肺固表，选项补肺固卫（B对）最接近教材表述。补肾纳气（A错）为哮喘之肾虚不纳证的治法。健脾化痰（C错）为哮喘之脾气虚弱证的治法。温肺化痰，止咳平喘（D错）寒性哮喘的治法。回阳固脱，温肺平喘（E错）为哮喘之喘脱危证的治法。